正中神经叙述错误的是
A. 发自臂丛后束
B. 支配拇收肌以外的鱼际肌
C. 损伤后拇指、食指不能屈曲
D. 损伤后出现“猿掌”征
E. 损伤后屈腕减弱

正确答案：A。发自臂丛后束

解析：正中神经发自臂丛内侧束和外侧束的内侧根和外侧根（A错，为本题正确选项），正中神经的返支行于桡动脉掌浅支外侧进入鱼际，支配除拇收肌以外的鱼际肌群（B对）。损伤后表现为该神经所支配的肌收缩无力和手掌感觉障碍，拇指、食指不能屈曲（C对），出现腕管综合征，表现为鱼际肌萎缩，手掌变平呈“猿掌”（D对），同时桡侧三个半手指掌面皮肤及桡侧半手掌出现感觉障碍，屈腕减弱（E对）。